患者，女，45岁。性情急躁易怒，胸胁胀满，口苦而干，头痛，目赤，耳鸣，大便秘结，舌红苔黄，脉弦数。治疗应首选
A. 柴胡疏肝散
B. 丹栀逍遥散
C. 半夏厚朴汤
D. 甘麦大枣汤
E. 天王补心丹

正确答案：B。丹栀逍遥散

解析：柴胡疏肝散为郁证肝气郁结证的选方，功能疏肝理气，活血止痛（A错）。题中患者以急躁易怒，胸胁胀满为主症，故诊断为郁证。胸胁胀满为肝气郁结，疏泄不利所致，性情急躁易怒，为肝郁日久化火所致，火伤津液，肝火横逆犯胃，故口苦而干，肝火上炎，扰乱清窍，故见头痛、目赤、耳鸣，火热结于肠道，故大便秘结，舌红苔黄，脉弦数为气郁化火之象，故辨为气郁化火证，治宜疏肝解郁，清肝泻火，方选丹栀逍遥散（B对）。半夏厚朴汤为郁证痰气郁结证的选方，功能行气开郁，降逆化痰（C错）。甘麦大枣汤为郁证心神失养证的选方，功能养心安神，和中缓急（D错）。天王补心丹常合六味地黄丸治疗郁证心肾阴虚证，功能滋阴降火，养心安神（E错）。